含有氧桥结构，中枢作用较强，用于预防和治疗晕动症的药物是
A. 硫酸阿托品
B. 氢溴酸东莨菪碱
C. 氢溴酸后马托品
D. 异丙托溴铵
E. 丁溴酸东莨菪碱

正确答案：B。氢溴酸东莨菪碱

解析：本题考查常用药物的结构特征与作用。氢溴酸东莨菪碱（B对）含有氧桥结构，中枢作用较强，用于预防和治疗晕动症。东莨菪碱的醇部分在6，7位间比阿托品多一个β-取向的氧桥基团，脂溶性增强。硫酸阿托品（A错）是一种抗胆碱药。该品与M胆碱受体结合，可解除平滑肌痉挛、抑制腺体分泌、解除迷走神经对心脏的抑制。氢溴酸后马托品（C错）为M胆碱受体阻断剂，比阿托品作用效应快且弱，临床上用于眼底检查及验光。异丙托溴铵（D错）为M胆碱受体拮抗剂类平喘药。丁溴东莨菪碱（E错）为东莨菪碱季铵化得到的药物，是外周抗胆碱药。